阴虚体质人群饮食中应少用
A. 乳品
B. 鱼类
C. 蜂蜜
D. 豆制品
E. 葱姜

正确答案：E。葱姜

解析：葱姜是辛辣之品，会加重阴虚（E对）；阴虚体质者，应该保阴潜阳，多吃清淡食物，如蜂蜜、乳品、豆腐、鱼等（ABCD错）。